若饮水中的氟含量高于多少可以引起氟牙症
A. 百万分之五
B. 百万分之一
C. 百万分之二
D. 百万分之三
E. 百万分之四

正确答案：B。百万分之一

解析：在牙齿发育阶段，如果饮用水中氟含量高于百万分之一（1ppm），或经其他途径摄入过多的氟，氟离子可导致釉质形成不全和钙化不全，这种釉质的发育障碍即为氟牙症。掌握“氟牙症、先天性梅毒牙与牙本质形成缺陷”知识点。